母儿血型不合瘀热证的治疗方剂为
A. 茵陈二黄汤
B. 茵陈寄生汤
C. 二丹茜草汤
D. 知柏地黄丸
E. 茵陈五苓散

正确答案：C。二丹茜草汤

解析：母儿血型不合之瘀热互结证主因素体抑郁，气郁血滞，日久成瘀，或肝郁化火，或孕期摄生不慎，感受热邪，瘀热互结胞中，内犯胎体而患病。治宜清热凉血，化瘀安胎，方用滋阴清热，凉血安胎的二丹茜草汤（C对）。母儿血型不合之湿热内蕴证的治疗方剂为茵陈二黄汤（A错）。阴虚血热证的治疗方剂为知柏地黄丸（D错）加茵陈、桑寄生、菟丝子。母儿血型不合之热毒内结证的治疗方剂是茵陈寄生汤（B错）。茵陈五苓散（E错）主治湿热黄疸，湿重于热，小便不利者。